当外阴部受损伤时，最易形成血肿的部位是
A. 大阴唇
B. 小阴唇
C. 阴阜
D. 阴蒂
E. 前庭大腺

正确答案：A。大阴唇

解析：大阴唇皮下为疏松结缔组织和脂肪组织，含丰富的血管、淋巴管和神经，外伤后易形成血肿（A对）。